大黄不能主治的病证是
A. 肠燥便秘
B. 水火烫伤
C. 湿热黄疸
D. 跌打损伤
E. 湿热泻痢初起

正确答案：A。肠燥便秘

解析：本题考查的是大黄的主治病证。大黄不能主治的病证是肠燥便秘（A错，为本题正确答案）。大黄：【主治病证】（1）大便秘结，胃肠积滞，湿热泻痢初起（E对）。（2）火热上攻之目赤、咽喉肿痛、口舌生疮、牙龈肿痛。（3）热毒疮肿，水火烫伤（B对）。（4）血热之吐血、衄血、咯血、便血。（5）瘀血闭经，产后瘀阻腹痛，癥瘕积聚，跌打损伤（D对）。（6）湿热黄疸（C对），淋证涩痛。肠燥便秘为火麻仁的主治病证。火麻仁：【主治病证】老人、产妇及体虚之津枯肠燥便秘。